嗜神经病毒是
A. 狂犬病病毒
B. 人乳头瘤病毒
C. 人类细小病毒
D. 人类免疫缺陷病毒
E. 疱疹病毒

正确答案：A。狂犬病病毒

解析：狂犬病病毒是弹状病毒科狂犬病毒属中能引起急性脑组织病变的嗜神经病毒。掌握“狂犬病、人乳头瘤病毒”知识点。